有关经皮给药制剂的优点的错误表述是
A. 可避免肝脏的首过效应
B. 可延长药物作用时间，减少给药次数
C. 可维持恒定的血药浓度，避免口服给药引起的峰谷现象
D. 适用于给药剂量较大、药理作用较弱的药物
E. 使用方便，可随时中断给药

正确答案：D。适用于给药剂量较大、药理作用较弱的药物

解析：本题考查经皮给药制剂的特点。经皮给药制剂起效慢，不适用于给药剂量较大、药理作用较弱的药物（D错，为本题正确答案）。经皮给药制剂的优点有：①避免肝脏的首过效应（A对）；②延长作用时间，减少给药次数（B对）；③维持恒定的血药浓度（C对）；④患者可以自主用药，使用方便，可以根据个体情况随时中断给药（E对）。